麦门冬汤中体现培土生金的药物是
A. 白术、茯苓
B. 山药、甘草
C. 粳米、大枣
D. 人参、大枣
E. 白术、甘草

正确答案：C。粳米、大枣

解析：麦门冬汤功用为滋养肺胃，降逆下气，主治肺胃津伤证。方中重用麦冬为君，养肺胃之阴，又清肺胃虚热。半夏降逆下气、化痰和胃，人参益气生津为臣。佐以甘草、粳米、大枣益气养胃，合人参益胃生津，胃津充足，自能上归于肺，此正"培土生金"之法（C对）。